上界为蝶骨大翼的颞下面和颞下嵴，下界是翼外肌下缘平面，并与翼下颌间隙分界的间隙是
A. 咬肌间隙
B. 眶下间隙
C. 下颌下间隙
D. 颊间隙
E. 颞下间隙

正确答案：E。颞下间隙

解析：颞下间隙位于颅中窝底。前界为上颌结节及上颌颧突后面；后界为茎突及茎突诸肌；内界为蝶骨翼突外板的外侧面；外界为下颌支上份及颧弓；上界为蝶骨大翼的颞下面和颞下嵴；下界是翼外肌下缘平面，并与翼下颌间隙分界。掌握“翼下颌间隙、颞下间隙感染”知识点。